蛔虫的防治方法错误的是
A. 开展卫生教育
B. 养成良好的卫生习惯，饭前便后洗手
C. 常用药物是扑蛲灵
D. 勤剪指甲
E. 搞好环境卫生，加强粪便管理

正确答案：C。常用药物是扑蛲灵

解析：蛔虫病的预防包括开展卫生宣传（A对），教育儿童养成良好的卫生习惯（B对），勤剪指甲（D对），勤洗手，不吸吮手指，不在地上爬玩，不吃生冷及未洗净的瓜果；搞好环境卫生，加强粪便管理，切断传染途径（E对），减少感染的机会，保持水源及食物不受污染。扑蛲灵为驱蛲虫常用药（C错，为本题正确答案）